铅及无机化合物进入人体的主要途径是
A. 皮肤
B. 皮肤和呼吸道
C. 呼吸道
D. 皮肤和消化道
E. 消化道

正确答案：C。呼吸道